关于氧化磷酸化解释正确的是
A. 包括呼吸链电子传递的还原过程
B. 包括ADP磷酸化
C. 包括ATP磷酸化
D. 生成ADP相耦联
E. 以上均正确

正确答案：B。包括ADP磷酸化

解析：氧化磷酸化：呼吸链电子传递的氧化过程与ADP磷酸化，生成ATP相耦联的过程称氧化磷酸化。掌握“氧化磷酸化”知识点。